医学模式转变对医师提出的根本性医学伦理学要求是
A. 学习伦理学
B. 学习生命价值论
C. 学习公益理论
D. 更加关注处于社会关系中的、作为一个整体的病人的人文方面
E. 注重改变传统的医学道德观念

正确答案：D。更加关注处于社会关系中的、作为一个整体的病人的人文方面